下列关于带菌者的理解，正确的一项是
A. 体内携带有细菌但不产生临床症状的健康人
B. 体内携带有细菌且产生临床症状的病人
C. 体内携带有致病菌但不产生临床症状的人
D. 体内携带有致病菌且产生临床症状的病人
E. 以上都不是

正确答案：C。体内携带有致病菌但不产生临床症状的人

解析：带菌者：细菌隐性感染者、潜伏期带菌者以及病后慢性带菌者均无临床症状，却持续性或间歇性向体外排菌，称为带菌状态，处于带菌状态的个体，称为带菌者。掌握“医院感染及细菌的致病性”知识点。